分布于肋弓平面
A. 第2胸神经
B. 第4胸神经
C. 第6胸神经
D. 第8胸神经
E. 第10胸神经

正确答案：D。第8胸神经

解析：神经前支在胸、腹壁皮肤的分布具有非常明显的节段性特点，其分布依胸神经从小到大的序数，由上向下按顺序依次排列。.第2胸神经（A错）相当于胸骨角平面。第4胸神经（B错）相当于乳头平面。第6胸神经（C错）相当于剑突平面。第8胸神经（D对）分布于肋弓平面。第10胸神经（E错）相当于脐平面。